以动物的生理产物入药的药材有
A. 蝉蜕
B. 蟾酥
C. 珍珠
D. 麝香
E. 牛黄

正确答案：A、B、D。蝉蜕；蟾酥；麝香

解析：本题考查的是动物类中药的药用部位。以动物的生理产物入药的药材有蝉蜕（A对）、蟾酥（B对）、麝香（D对）。动物的生理产物，分泌物：如麝香、蟾酥、熊胆粉、虫白蜡、蜂蜡等。排泄物：如五灵脂、蚕沙、夜明砂等。其他生理产物：如蝉蜕、蛇蜕、蜂蜜、蜂房等。动物的病理产物如珍珠（C错）、僵蚕、牛黄（E错）、马宝、猴枣、狗宝等。